股骨大转子至腘横纹的骨度分寸是
A. 13寸
B. 14寸
C. 16寸
D. 18寸
E. 19寸

正确答案：E。19寸

解析：股骨大转子至腘横纹骨度分寸为19寸（E对），用于确定大腿前外侧部腧穴的纵向距离。